后牙区（牙合）堤平面应平行于
A. 上唇
B. 瞳孔连线
C. 鼻底
D. 鼻翼耳屏线
E. 眶耳平面

正确答案：D。鼻翼耳屏线

解析：本题考查后牙区（牙合）堤平面。后牙区（牙合）堤平面即（牙合）平面的后部，从侧面观要与鼻翼耳屏线平行（D对）。（牙合）堤平面在前牙处位于上唇下缘（A错）下2mm处。（牙合）堤平面前部与瞳孔连线（B错）平行。（牙合）堤平面与鼻底（C错）没有具体的位置关系。（牙合）堤平面后部与鼻翼耳屏线平行，与眶耳平面（E错）呈15°角。